患者右上腹痛牵涉右肩背，突发畏寒高热，巩膜皮肤黄染，最可能为
A. 急性胆囊炎
B. 急性胰腺炎
C. 黄疸型肝炎
D. 壶腹部周围肿瘤
E. 急性化脓性梗阻性胆管炎

正确答案：E。急性化脓性梗阻性胆管炎

解析：右上腹痛牵涉右肩背，突发畏寒高热，巩膜皮肤黄染，最可能为急性化脓性梗阻性胆管炎。胆管壁黏膜糜烂，出现溃疡，胆管明显扩张，胆汁淤积，胆管内压力增高，管腔内充满脓性胆汁（E对）。急性胆囊炎局部体征表现为患者右上腹有压痛，约25%的患者可触及肿大胆囊，患者在深吸气或咳嗽时，放于右肋下的手指会触到肿大的胆囊，患者会因疼痛突然终止吸气（murphy征），右上腹有压痛、肌紧张及反跳痛，当胆囊穿孔后会出现全腹的炎症（A错）。急性胰腺炎临床以急性上腹痛、恶心、呕吐、发热和血胰酶增高等为特点（B错）。黄疸型肝炎是基于有无黄疸表现及血清胆红素水平是否升高来定义的，与之相对应的是无黄疸型肝炎（C错）。壶腹部周围肿瘤，这是由于该部位常有十二指肠及胃内积气及食物掩盖所致（D错）。